患者起病急骤，腹痛剧烈，大便频频，痢下鲜紫脓血，伴有壮热口渴，头痛烦躁，恶心呕吐，舌红绛，苔黄燥，脉滑数。治疗应首选
A. 芍药汤
B. 白头翁汤合芍药汤
C. 藿香正气丸
D. 连理汤
E. 黄连阿胶汤

正确答案：B。白头翁汤合芍药汤

解析：芍药汤为湿热痢的选方，功能调气行血，清热解毒（A错）。题中患者起病急骤，以腹痛剧烈，大便频频，痢下鲜紫脓血为主症，故诊断为痢疾。起病急骤为疫毒之邪侵袭，其性猛烈，伤人最速所致，热毒内蕴，气机不利，腑气不通，故腹痛剧烈，疫毒与气血搏结于肠道，腐败化为脓血，故大便频频，痢下鲜紫脓血，疫毒盛于内，热因毒发，故壮热，热盛则伤阴，故口渴，热扰于上，故头痛，热扰心神，故烦躁，疫毒之邪扰动胃腑，故恶心呕吐，舌红绛，苔黄燥，脉滑数皆为热毒内炽之象，故辨为疫毒痢，治宜清热解毒，凉血除积，方选白头翁汤合芍药汤（B对）。霍香正气丸用于治疗暑天感寒湿而痢者，功能祛暑散寒，化湿止痢（C错）。连理汤为休息痢的选方，功能温中补脾兼清湿热（D错）。黄连阿胶汤常合驻车丸治疗阴虚痢，功能坚阴清热（E错）。